脊休克产生的原因是
A. 损伤性刺激对脊髓的抑制作用
B. 脊髓中的反射中枢被破坏
C. 脊髓失去了高位中枢的调节作用
D. 血压下降使脊髓缺血
E. 躯体感觉传入冲动受阻

正确答案：C。脊髓失去了高位中枢的调节作用